根据《执业药师资格制度暂行规定》，执业药师欲变更执业地区，应当
A. 重新申请执业药师资格考试
B. 办理变更注册手续
C. 办理注销注册手续
D. 办理再注册手续
E. 直接到新地区执业，不需要办理注册手续

正确答案：B。办理变更注册手续

解析：本题考查的是执业药师变更注册与注销注册。根据《执业药师资格制度暂行规定》，执业药师欲变更执业地区，应当办理变更注册手续（B对）。执业药师变更注册与注销注册：执业药师变更执业单位、执业范围等应当及时办理变更注册手续。办理变更注册手续，应填写《执业药师变更注册申请表》，并按要求准备相关材料，交执业单位所在地省级药品监督管理部门（变更执业地区的申请材料应交新执业单位所在地省级药品监督管理部门）办理变更注册手续（E错）。对于以上资料，注册机构核对原件和复印件无误后，应当将原件返还申请人。注册机构应当自受理变更注册申请之日起7个工作日内作出准予变更注册的决定，收回原《执业药师注册证》，颁发新的《执业药师注册证》。变更执业范围、执业地区、执业单位，注册有效期不变。执业药师注册后如有下列情况之一的，应予以注销注册（C错）：①死亡或被宣告失踪的；②受刑事处罚的；③被吊销《执业药师职业资格证书》的；④受开除行政处分的；⑤因健康或其他原因不能从事执业药师业务的；⑥无正当理由不在岗执业超过半年以上者；⑦注册许可有效期届满未延续的。注销手续由执业药师本人或其所在单位向注册机构申请办理。